麝香辛香走窜，温通行散，其成人的一日内服量是
A. 0.01～0.015g
B. 0.03～0.1g
C. 0.02～0.025g
D. 0.15～0.3g
E. 0.5～1g

正确答案：B。0.03～0.1g

解析：本题考查麝香的用法用量。麝香辛香走窜，温通行散，其成人的一日内服量是0.03～0.1g（B对）。麝香【用法用量】内服：入丸散，0.03～0.1g，不入煎剂。外用：适量，调敷或敷贴。冰片【用法用量】内服：入丸散，0.15～0.3g（D错），不入煎剂。外用：适量，研末干掺或调敷。细辛【用法用量】内服：煎汤，1～3g；粉末，0.5～1g（E错）。外用：适量，研末吹鼻、塞耳、敷脐，或调涂。亦可煎汤含漱。